异化扩散与简单扩散的主要区别在于
A. 前者需要能量，后者不需要
B. 前者需要载体，后者不需要
C. 前者没有特异性，后者有特异性
D. 前者不需要能量，后者需要
E. 前者没有饱和性，后者有

正确答案：B。前者需要载体，后者不需要